从延髓脑桥沟出入的脑神经，自内侧向外侧分别为
A. 展神经、面神经、动眼神经
B. 展神经、面神经、前庭蜗神经
C. 展神经、面神经、三叉神经
D. 面神经、前庭蜗神经、迷走神经
E. 前庭蜗神经、面神经、展神经

正确答案：B。展神经、面神经、前庭蜗神经

解析：从延髓脑桥沟出入的脑神经，自内侧向外侧分别为展神经、面神经、前庭蜗神经（B对）。